女，45岁。腹泻10年。精神紧张时加剧，排便前腹痛，排便后腹痛可缓解。大便为糊状，发病以来体重无明显变化。既往体健，平素进食好，睡眠差。查体：T36.5℃，P80次／分，R18次／分，BP120/80mmHg。未见皮疹，双肺呼吸音清，未闻及干湿性啰音，心律齐。腹软，无压痛。适宜的治疗措施是
A. 微生态制剂
B. 抗结核治疗
C. 手术治疗
D. 抗生素
E. 糖皮质激素

正确答案：A。微生态制剂

解析：女性患者，腹泻10年。精神紧张加剧（和精神因素有关），排便后缓解且大便性状为糊状（无粘液脓血便），体检无异常，仅有腹痛和排便异常可考虑肠易激综合征。肠易激综合征的治疗旨在改善病人症状，提高生活质量、消除顾虑。一般治疗了解促发因素，并设法予以去除；指导病人建立良好的生活习惯及饮食结构，避免诱发症状的食物。告知病人IBS 的性质，解除病人顾虑。对伴有失眠、焦虑者可适当给予镇静药。肠道微生态制剂（A对）能纠正菌群失调、对腹泻、腹胀有帮助；抗结核治疗（B错）适用于肠结核病；手术治疗用（C错）于无法扭转的器质性病变；抗生素（D错）适用于胃肠道的细菌感染；糖皮质激素（E错）可用于克罗恩病的治疗。